与膀胱贮尿和排尿功能直接相关的是
A. 脾的运化功能
B. 肾的气化功能
C. 气的固摄功能
D. 气的推动功能
E. 肺的宣发功能

正确答案：B。肾的气化功能

解析：本题考查的是肾的生理功能。与膀胱贮尿和排尿功能直接相关的是肾的气化功能（B对）。肾与膀胱：肾与膀胱通过经脉相互络属，构成表里关系。膀胱的贮尿和排尿功能，均依赖于肾的气化。肾气充足，则固摄有权，膀胱开合有度，以维持津液的正常代谢。在病变方面，肾的功能失常，常会影响到膀胱。例如，肾气虚衰，固摄无权，则膀胱开合无度，可见尿频、小便清长、遗尿，甚或尿失禁等；若肾阳虚衰，肾与膀胱气化不利，可见小便不利，甚或癃闭等。脾的运化功能（A错）：（1）运化水谷精微，是指脾对饮食物的消化和水谷精微的吸收、转输、布散的作用。（2）运化水液，是指脾对水液的吸收、转输和布散作用。气的固摄作用（C错）：气的固摄作用，主要是对于精、血、津液等物质具有防止其无故流失，以及维护脏腑器官各自位置的相对恒定等作用。气的推动作用（D错）：气是活动能力极强的精微物质，对人体生长发育、各脏腑组织器官的功能活动、血液的循行、津液的生成输布和排泄等，均能发挥激发和推动作用。肺的宣发功能（E错）：指肺气具有向上、向外、升宣、发散的生理功能。